不符合神经症性障碍共同特点的是
A. 患者常有一定的易感素质
B. 多无明显的精神病性症状
C. 症状可有相应的器质性病变
D. 与心理社会因素有关
E. 多数患者对疾病有自知力

正确答案：C。症状可有相应的器质性病变

解析：神经症性障碍没有发现肯定的器质性病变（C错，为本题正确答案），可有一定的易感素质（A对），无精神病性症状（B对），起病常与社会心理因素有关（D对），对疾病有相当的自知力（E对）。